微囊藻毒素MC-LR主要作用于肝细胞和肝巨噬细胞，可强烈抑制
A. 酪氨酸/苏氨酸蛋白磷酸酶-1的活性
B. 亮氨酸/苏氨酸蛋白磷酸酶-1的活性
C. 蛋氨酸/苏氨酸蛋白磷酸酶-1的活性
D. 丝氨酸/苏氨酸蛋白磷酸酶-1的活性
E. 谷氨酸/苏氨酸蛋白磷酸酶-1的活性

正确答案：D。丝氨酸/苏氨酸蛋白磷酸酶-1的活性

解析：本题考查微囊藻毒素的相关内容。微囊藻毒素MC-LR主要作用于肝细胞和肝巨噬细胞，可强烈抑制丝氨酸/苏氨酸蛋白磷酸酶-1（PP1）（D对ABCE错）和蛋白磷酸酶-2A（PP2A）的活性。